男性，45岁。肥胖体形，无异常症状，健康查体时发现尿糖阳性。空腹血糖稍高，葡萄糖耐量减低。其诊断考虑为
A. Ⅱ型糖尿病
B. Ⅰ型糖尿病
C. 糖尿病酮症酸中毒
D. 肾炎
E. 肾病

正确答案：A。Ⅱ型糖尿病

解析：患者45岁（Ⅱ型糖尿病多在40以后起病），肥胖体型，无异常症状（Ⅱ型糖尿病通常伴有肥胖症，且起病隐匿），检查尿糖阳性，空腹血糖增高，葡萄糖耐量降低（提示糖代谢异常），综合该患者体查、实验室检查，诊断考虑为Ⅱ型糖尿病（A对）。Ⅰ型糖尿病（P737）（B错）好发于青少年，起病较急，多尿、多饮、多食和体重减轻等症状明显。糖尿病酮症酸中毒（P753）（C错）临床症状突出，主要表现为恶心、呕吐、头痛，呼吸深快等，呼气有烂苹果味，查血酮体阳性。肾炎（P461）（D错）主要表现为血尿、蛋白尿、水肿和高血压等。肾病（P461）（E错）主要表现为大量蛋白尿、低蛋白血症、明显水肿和（或）高脂血症。